用汞量法测定青霉素钠的含量，以下叙述中正确的有
A. 首先加氢氧化钠溶液使青霉素钠降解
B. 用硝酸汞滴定液滴定
C. 用醋酸汞滴定液滴定
D. 用铬酸钾指示终点
E. 用电位法指示终点

正确答案：A、B、E。首先加氢氧化钠溶液使青霉素钠降解；用硝酸汞滴定液滴定；用电位法指示终点